患者，女，眩晕8年，眩晕日久不愈，精神萎靡，腰膝酸软，少寐多梦，健忘，两目干涩，视力减退，五心烦热，舌红少苔，脉细数，治疗应首选的方剂是
A. 右归丸
B. 左归丸
C. 附子理中汤
D. 七味都气丸
E. 金匮肾气丸

正确答案：B。左归丸

解析：眩晕病分五个证型，即肝阳上亢证、痰湿中阻证、瘀血阻窍证、气血亏虚证、肾精不足证。本患者肾虚症状明显为肾精不足证且为肾阴虚，用左归丸加减（B对），右归丸、金匮肾气丸治肾阳虚（AE错）；附子理中丸治脾肾虚寒证（C错）；气味都气丸治肺肾阴虚喘咳；补益肾精之力不如左归丸（D错）。